RPD基托组织面不需作缓冲的部位是
A. 上颌结节颊侧
B. 上颌硬区
C. 下颌隆突
D. 磨牙后垫
E. 内斜嵴

正确答案：D。磨牙后垫

解析：本题考查RPD基托组织面的缓冲部位。磨牙后垫（D错，为本题的正确答案）主要起边缘封闭的作用，要保证此处基托与黏膜密切接触，使空气不能进入义齿基托与承托区黏膜之间，利用大气压力保证义齿的固位，因此不能在此处作缓冲处理。上颌结节颊侧（A对）、上颌硬区（B对）、下颌隆突（C对）、内斜嵴（E对）、骨尖等部位的基托，这些部位表面黏膜较薄，其组织面应做适当的缓冲，以免基托压迫组织产生疼痛。